毒性中药药性峻烈，治疗剂量与中毒剂量相近，使用不当会致人中毒甚则死亡，因此掌握毒性中药饮片的正确用法尤为重要。下列毒性中药不可内服的是
A. 雄黄
B. 白降丹
C. 生藤黄
D. 砒石
E. 蟾酥

正确答案：B。白降丹

解析：本题考查的是部分毒性中药品种的用法用量。下列毒性中药不可内服的是白降丹（B对）。白降丹的用法用量：外用适量，研末调敷或作药捻。注意事项：不可内服，具腐蚀性。雄黄（A错）的用法用量：0.05～0.1g，入丸散用。外用适量，熏涂患处。注意事项：内服宜慎；不可久用；孕妇禁用。生藤黄（C错）的用法用量：0.3～0.6g。外用适量。注意事项：内服慎用。砒石（D错）（红砒，白砒）的用法用量：内服0.002～0.004g，入丸散外用适量，研末撒、调敷或入膏药中贴之。注意事项：毒性大，用时宜慎；不宜与水银同用；体虚及孕妇忌服。蟾酥（E错）的用法用量：0.015～0.03g，多入丸散用。外用适量。注意事项：孕妇慎用。